女，72岁。摔伤右髋部，既往全身情况良好。查体：右下肢缩短，外旋畸形，下肢轴向叩击痛阳性。最佳治疗方法是
A. 持续皮牵引
B. 股骨近端截骨术
C. 人工髋关节置换术
D. 持续骨牵引
E. 髋关节石膏固定

正确答案：C。人工髋关节置换术

解析：老年女性患者，有摔伤史，右下肢缩短、外旋畸形（提示可能为股骨颈骨折）和轴向叩击痛阳性，结合患者病史、临床表现及体查，该患者最可能的诊断为右侧股骨颈骨折。该患者全身情况良好，但由于股骨头血液供应差，股骨头坏死发生率较高，因此多采用人工髋关节置换术（C对）。持续皮牵引（A错）或骨牵引（D错）（八版外科学P678）为股骨颈骨折的非手术治疗，适用于无明显位移、外展型或嵌入型等稳定性骨折及年龄过大、全身情况差、无法耐受手术者。股骨近端截骨术（B错）多用于股骨颈骨折难以愈合或发生股骨头坏死的病人。髋人字石膏固定（P602）（E错）用于发育性髋关节脱位6～18个月大幼儿的治疗。